下列哪种药物属于广谱抗癫痫药物
A. 苯巴比妥
B. 苯妥英钠
C. 丙戊酸钠
D. 硝西泮
E. 乙琥胺

正确答案：C。丙戊酸钠